患者，男性，50岁，上颌左67右567缺失，拟行整铸支架活动义齿修复，下列与铸造钴铬合金支架相匹配的包埋材料是
A. 石膏包埋材料
B. 磷酸盐包埋材料
C. 硅胶包埋材料
D. 正硅酸乙酯包埋材料
E. 硅溶胶包埋材料

正确答案：B。磷酸盐包埋材料

解析：本题考查磷酸盐包埋材料的适用范围。钴铬合金凝固收缩比较大，其对技术要求较高。由于磷酸盐包埋材有较大的温度膨胀性和一定的凝固膨胀性，可以补偿钴铬合金的凝固收缩，保证临床所需要的支架铸造精度（B对）。石膏包埋材料（A错）适用于铸造熔化温度在1000摄氏度以下的合金。硅胶包埋材（C错）分为硅溶胶包埋材（E错）和正硅酸乙酯包埋材（D错），均属于硅结合系包埋材，该类包埋材，凝固膨胀率较小，而温度膨胀率较大，不可用于钴铬合金。